女孩，1岁，发热伴咳嗽4天，查体：T38.8℃，P：128次/分，R：38次/分，双肺闻及固定的湿啰音，腹稍胀，肝肋下2cm，实验室检查，血WBC13.5×10⁹/L,N0.72,L0.18假设信息治疗中患儿呼吸困难加重，呕吐少许咖啡样物查体：P：140次/分，R：46次/分。严重腹胀，肠鸣音消失，最可能发并发症是
A. 感染性休克
B. 中毒性肠麻痹
C. 心力衰竭
D. 脑性低钠血症
E. 中毒性脑病

正确答案：B。中毒性肠麻痹

解析：假设信息治疗中患儿呼吸困难加重，呕吐少许咖啡样物查体：P：140次/分，R：46次/分。严重腹胀，肠鸣音消失，符合中毒性肠麻痹（B对）。感染性休克（A错）有昏迷，血压下降，尿量减少等休克症状。心力衰竭（C错）可有呼吸加快，心率加快，双下肢水肿。中毒性脑病（E错）表现为心烦躁、嗜睡、眼球上窜、凝视和球结膜水肿等。脑性低钠血症（D错）有血钠≤130mmol/L, 血渗透压<275mmol/L等表现。